正确描述手肌的是
A. 外侧群、内侧群各有4块肌
B. 蚓状肌有5条，每指1条
C. 骨间掌侧肌有4块
D. 骨间肌分为骨间掌侧肌和骨间背侧肌
E. 骨间背侧肌有3块

正确答案：D。骨间肌分为骨间掌侧肌和骨间背侧肌

解析：外侧群有4块肌，而内侧群只有3块肌，并非也是4块肌（A错）。蚓状肌只有4条，而非5条（B错）。骨间掌侧肌只有3块，而非4块。骨间肌分为骨间掌侧肌和骨间背侧肌（D对）。骨间背侧肌有4块，而非3块（E错）。